舍格伦综合征并发症不包括
A. 中耳炎
B. 心脏病
C. 重症肌无力
D. 末梢神经炎
E. 肾小管功能不全

正确答案：B。心脏病

解析：本题考查舍格伦综合征。舍格伦综合征并发症不包括心脏病（B错，为本题正确答案）。舍格伦综合征并发症可有肾间质淋巴细胞浸润可致肾小管功能不全（E对）；耳咽管阻塞可引起中耳炎（A对）。病变也可累及神经、肌及血管，出现感觉神经的末梢神经炎（D对），肌病变表现为多发性肌炎或重症肌无力（C对）。血管病变有小动脉炎、手足发绀、雷诺现象等。